颌骨放射性骨坏死主要X线表现
A. 颌骨斑点状或虫蚀壮破坏，边界不清楚
B. 多见骨膜反应
C. 没有明显的死骨形成
D. 主要表现为骨质增生
E. 边界清楚

正确答案：A。颌骨斑点状或虫蚀壮破坏，边界不清楚

解析：本题考查颌骨放射性骨坏死主要X线表现。颌骨放射性骨坏死主要X线表现是颌骨斑点状或虫蚀壮破坏，边界不清楚（A对）。由于多野照射、多次照射、多疗程照射，致放疗中难以严格控制辐射范围，所以病变边界多不清楚（E错）。病理性骨折多发生于下颌骨，骨膜对放射线高度敏感，放射线照射后的骨膜活力明显降低，甚至消失，因而很少发生骨膜成骨，骨膜反应不多见（B错）。颌骨有牙存在时，放射性骨坏死易继发感染，病变常从牙槽突开始，当病变以牙槽突为主时，表现为局部骨质疏松及根尖周密度减低影像，没有骨质增生的表现（D错）。随病变进展，骨吸收破坏加重、范围增大，有较大死骨形成（C错）。